女，42岁。烧心半年，无吞咽困难，胃镜检查提示慢性浅表性胃炎。为进一步明确诊断，应进行的检查是
A. 24小时食管PH监测
B. 食管脱落细胞学检查
C. 胸部CT
D. 食管X线钡剂造影
E. 动态心电图

正确答案：A。24小时食管PH监测

解析：患者为中年女性，烧心（胃食管反流病的典型症状）半年，无吞咽困难，胃镜检查提示慢性浅表性胃炎（内镜检查胃食管反流病阴性），为进一步明确诊断，应进行的检查是24小时食管pH监测（A对）。如证实有食管过度酸反流，则胃食管反流病（GERD）诊断成立。食管脱落细胞学检查（B错）是诊断食管癌的检查方法。胸部CT（C错）对于确诊胃食管反流病意义不大。食管X线钡剂造影（D错）对诊断RE的敏感性不高，适用于不愿接受或不能耐受胃镜检查的患者。动态心电图（E错）主要对有胸痛的胃食管反流病患者与心源性胸痛进行鉴别，并不能诊断胃食管反流病。